常发生双侧颈淋巴结转移的是
A. 唇癌
B. 颊黏膜癌
C. 皮肤癌
D. 口底癌
E. 中央性颌骨癌

正确答案：D。口底癌

解析：口底癌常早期发生淋巴结转移，转移率仅次于舌癌，一般转移至颏下、下颌下及颈深淋巴结，但大都先有下颌下区转移，以后转移到颈深淋巴结，并常发生双侧颈淋巴结转移。掌握“颊癌、口底癌及唇癌”知识点。